前囟的闭合时间
A. 出生前
B. 出生后
C. 生后6个月
D. 1-2岁
E. 3-4岁

正确答案：D。1-2岁

解析：前囟在生后 1 -2 岁时闭合，其余各囟均于生后不久闭合（D对）。